恒重是指两次称量的毫克数不超过
A. 0.3
B. 0.95～1.05
C. 1.5
D. 6
E. 10

正确答案：A。0.3

解析：本题考查中国药典的凡例。恒重是指两次称量的毫克数不超过0.3（A对）。“恒重”，除另有规定外，系指供试品连续两次干燥或烧灼后的重量差异在0.3mg以下的重量。